某研究者拟采用多中心、随机、双盲临床试验评价补肾活血颗粒改善帕金森病患者运动功能的有效性，试验组使用的中药配方包括山茱萸、何首乌和当归等成分。对照组用药由淀粉、糊精和苦味剂等成分制成，其气味、口感与试验用药非常近似，但没有药理作用。该试验采用的对照属于
A. 交叉对照
B. 标准方法对照
C. 自身对照
D. 安慰剂对照
E. 空白对照

正确答案：D。安慰剂对照

解析：该临床试验用药试验组用的是改善帕金森病运动功能的补肾活血颗粒，而对照组用的是没有药理作用但口感外观等都与试验组药物近似的药物，称为安慰剂，是为了排除非特异效应的干扰（D对）。交叉对照是按随机方法将研究对象分为甲、乙两组，甲组先用试验药，乙组先用对照药。一个疗程后两组交换用药，本试验没有提到交换过程（A错）。标准对照即给对照组以常规或现行最好的疗法，本试验对照组药物无治疗效果（B错）。自身对照的临床试验不分组，比较的是统一研究对象用药前后某些指标的变化（C错）。空白对照就是不给予对照组任何措施（E错）。